64岁，2周前无明显诱因出现咳嗽，咳黄白痰带血丝，经抗生素治疗效果不佳。体检：体温37.8℃，血压正常，右上肺呼吸音稍弱伴少许湿啰音。血象WBC12×10⁹/L，N0.83。最有助于诊断的检查是
A. 胸部B超
B. 肺动脉造影
C. 痰培养+药敏
D. 支气管镜检
E. 支气管造影

正确答案：D。支气管镜检

解析：患者为中老年男性（为肺癌的好发年龄），出现阵发性干咳和持续痰中带血，经抗生素治疗效果不佳（抗生素对肺癌无效），根据其临床表现体征，考虑为支气管肺癌的可能性很大（支气管肺癌阻塞支气管常引起远端肺化脓性感染，阻塞性感染由于支气管引流不畅，抗生素效果不佳。因此对40岁以上出现肺同一部位反复感染，且抗生素疗效差的患者，要考虑支气管肺癌引起阻塞性肺炎的可能）。支气管镜检（D对）可明确诊断支气管肺癌，为该患者首选检查。胸部B超（A错）主要用来诊断胸腔积液，也可作为肺癌的辅助诊断，但不是首选。肺动脉造影（B错）多在疑诊肺血栓栓塞症时选用。痰培养+药敏（C错）用于肺部一般细菌感染。支气管造影（E错）是以前支气管扩张的首选检查，目前被高分辨率CT取代。